子宫内膜癌首选的治疗方法是
A. 化疗
B. 手术治疗
C. 放射治疗
D. 内分泌治疗
E. 免疫治疗

正确答案：B。手术治疗

解析：本题考查子宫内膜癌的治疗方法。子宫内膜癌首选的治疗方法是手术治疗（B对）。化疗（A错）主要用于晚期或复发子宫内膜癌，或用于术后有复发高危因素患者的治疗以期减少盆腔外的远处转移。放射治疗（C错）适用于有手术禁忌症或无法手术切除的晚期患者，也可放疗和手术及化疗联合应用以提高疗效。内分泌治疗（D错）主要用孕激素，主要用于晚期或复发癌，也可试用于极早期要求保留生育功能的年轻患者。子宫内膜癌不使用免疫治疗（E错）。